用骨龄（BA）与实际年龄（CA）判断成熟类型，早熟类型应该是
A. BA﹤CA
B. BA﹥CA
C. BA≠CA
D. BA＝CA
E. 以上都不是

正确答案：B。BA﹥CA

解析：本题考查骨龄与年龄的关系。若骨龄（BA）明显大于实际年龄（CA）（B对CDE错），提示患者存在发育提前的问题，也称为早熟。早熟会导致骨骺提前愈合，生长期明显缩短，会影响身高发育，导致成年后身高偏矮。若骨龄（BA）明显小于实际年龄（CA），提示患者发育落后，也称为晚熟（A错）。骨骺线闭合时间较晚，超过两岁说明生长发育落后，可能与生长激素缺乏、甲状腺功能减退等疾病有关，需进行具体的检查来确定病因，以免影响生长发育。